热哮之痰是
A. 痰稀薄色白，咯吐不爽
B. 痰黄或白，黏浊稠厚难咯
C. 痰脓腥臭
D. 痰多夹杂腐肉
E. 痰如白沬，夹有血丝

正确答案：B。痰黄或白，黏浊稠厚难咯

解析：热哮病机为痰热壅盛，肺失宣降。热哮之痰因热蒸液聚生痰，痰热互结，故其表现为痰黄或白，黏浊稠厚难咯（B对）。痰稀薄色白，咯吐不爽（A错）可见于冷哮证。痰脓腥臭（C错）、痰多夹杂腐肉（D错）可见于肺痈。痰如白沬，夹有血丝（E错）可见于肺痨。